TDDS制剂中常用的压敏胶材料是
A. 聚乙烯醇
B. 羟丙甲纤维素
C. 聚乙烯
D. 聚异丁烯
E. 聚丙烯

正确答案：D。聚异丁烯

解析：本题考查经皮给药制剂的处方材料。聚异丁烯类（D对）在TDDS制剂中作为压敏材料。TDDS中常用的压敏胶有聚异丁烯类、丙烯酸类和硅橡胶三类。